丙咪嗪可用于治疗
A. 癫痫
B. 精神分裂症
C. 躁狂症
D. 抑郁症
E. 惊厥

正确答案：D。抑郁症

解析：本题考查丙咪嗪。丙咪嗪可用于治疗抑郁症（D对）。丙咪嗪为三环类抗抑郁药，主要通过抑制突触前膜对5-HT及去甲肾上腺素的再摄取，使突触间隙的去甲肾上腺素和5-HT浓度升高，促进突触传递功能而发挥抗抑郁作用。此类药物还有阿米替林、氯米帕明、多塞平等。抗癫痫（A错）药有苯巴比妥、地西泮、卡马西平等。抗精神分裂症（B错）药有氯丙嗪、氟哌啶醇、利培酮等。抗躁狂症（C错）药物主要有碳酸锂。抗惊厥（E错）药有水合氯醛、地西泮、硫酸镁等。